男，22岁，乏力，纳差1个月，水肿少尿伴血压升高1周，尿蛋白（++），RBC30～50/HP，血Hb76g/L，补体C3正常，肌酐421μmol/L，B超提示双肾增大，血清抗肾小球基底膜阳性，最可能的诊断是
A. 急进性小球肾炎Ⅱ型
B. 急性肾小球肾炎
C. 急进性小球肾炎Ⅲ型
D. 急进性肾小球肾炎Ⅰ型
E. 急性肾小管坏死

正确答案：D。急进性肾小球肾炎Ⅰ型

解析：患者青年男性，乏力，纳差1个月，水肿少尿伴血压升高1周，尿蛋白（++）（正常不可见），RBC30～50/HP（正常不可见），血Hb76g/L（男性正常＞120 g/L），补体C3正常（急性肾小球肾病会出现一过性C3降低），肌酐421μmol/L（男性肌酐正常值54～106μmoI/L，肾功能不全失代偿期），B超提示双肾增大，血清抗肾小球基底膜阳性（急进性肾小球肾炎Ⅰ型典型特征）。综合患者症状及实验室检查，考虑诊断为急进性肾小球肾炎Ⅰ型（D对）。急进性小球炎Ⅱ型（A错）患者血液循环免疫复合物及冷球蛋白可呈阳性。急进性小球炎Ⅲ型（C错）患者ANCA阳性。急性肾小球肾炎（B错）病情进展相对缓慢，一过性C3降低。急性肾小管坏死（E错）一般表现为进行性氮质血症、水电解质与酸碱平衡失调和相关的一系列症状。